生理性体重下降的范围一般是出生体重的
A. 1%～5%
B. 3%～9%
C. 5%～10%
D. 10%～15%
E. 15%～20%

正确答案：B。3%～9%

解析：由于哺乳量的不足、不显性失水、排尿及排出胎便，出生后3～4日内有生理性体重下降，约下降原有体重的3%～9%，至7～10日体重逐渐恢复至出生时的体重。掌握“体格生长常用指标”知识点。